腭前神经阻滞麻醉注射针推进至腭大孔，注入麻药
A. 0.3～0.5ml
B. 0.5～1ml
C. 1～1.5ml
D. 1.5～2ml
E. 2～3ml

正确答案：A。0.3～0.5ml

解析：本题考查颌面部常用局麻法及牙拔除的麻醉选择。腭前神经阻滞麻醉，患者头后仰，大张口，上颌（牙合）平面与地平面成60°角。注射针在腭大孔的表面标志稍前出刺入腭黏膜，往上后方推进至腭大孔，注入麻药0.3～0.5ml（A对）。